一侧视神经损伤后，引起该眼瞳孔
A. 直接及间接对光反射均存在
B. 直接及间接对光反射均消失
C. 直接对光反射消失、间接对光反射存在
D. 直接对光反射存在、间接对光反射消失
E. 以上均不是

正确答案：C。直接对光反射消失、间接对光反射存在

解析：瞳孔对光反射在临床上有重要意义，反射消失，可能预示病危。但视神经或动眼神经受损，也能引起瞳孔对光反射的变化。一侧视神经受损时，信息传入中断，光照患侧眼的瞳孔，两侧瞳孔均不反应（C对）；但光照健侧眼的瞳孔，则两眼对光反射均存在（此即患侧眼的瞳孔直接对光反射消失，间接对光反射存在）。